干胶法制备乳剂是先制备初乳。在初乳中，在初乳中，油∶水∶胶的比例为挥发油∶水∶胶
A. 5∶2∶1
B. 4∶2∶1
C. 3∶2∶1
D. 2∶2∶1
E. 1∶2∶1

正确答案：D。2∶2∶1